治疗黄疸阴黄证，应首选
A. 麻黄连翘赤小豆汤
B. 栀子柏皮汤
C. 茵陈五苓散
D. 茵陈术附汤
E. 茵陈蒿汤

正确答案：D。茵陈术附汤

解析：麻黄连翘赤小豆汤功能宣肺利尿，主治风水在表之水肿（A错）。栀子柏皮汤用于治疗伤寒身黄发热者，为伤寒湿热郁于肌表（B错）。茵陈五苓散功能利湿退黄，为阳黄湿重于热证的选方（C错）。黄疸阴黄有寒湿阻遏证和脾虚湿滞证，寒湿阻遏证治宜温中化湿，健脾和胃，首选茵陈术附汤。脾虚湿滞证治宜健脾养血，利湿退黄，首选黄芪建中汤（D对）。茵陈蒿汤功能清热通腑，利湿退黄，为阳黄热重于湿证的选方（E错）。